关于原发性牙本质，其中的说法错误的是
A. 罩牙本质厚度为15～20μm
B. 胶原纤维排列与小管平行
C. 胶原纤维与牙齿表面垂直
D. 主要为Ⅰ型胶原
E. 位于透明层与髓周牙本质之内

正确答案：E。位于透明层与髓周牙本质之内

解析：关于原发性牙本质，其中的说法错误的是位于透明层与髓周牙本质之内（E错，为本题正确答案）。原发性牙本质是指牙齿发育过程中所形成的牙本质，在冠部靠近釉质和根部靠近牙骨质最先形成的牙本质，主要为Ⅰ型胶原（D对），胶原纤维的排列与小管平行（B对），且与表面垂直（C对），矿化均匀，镜下呈现不同的外观，在冠部者称为罩牙本质，厚度约为15～20μm（A对）；在根部者称为透明层，厚度约5～10μm。在罩牙本质与透明层以内的牙本质称为髓周牙本质。